生命质量测量中相对较为敏感的指标是
A. 活动受限
B. 认知功能
C. 情绪反应
D. 角色功能
E. 一般性感觉

正确答案：A。活动受限